牙体缺损最常见的原因是
A. 龋病
B. 外伤
C. 磨损
D. 酸蚀症
E. 楔状缺损

正确答案：A。龋病

解析：牙体缺损最常见的原因是龋病，其次是外伤、磨损、楔状缺损、酸蚀和发育畸形等。掌握“牙体缺损病因及影响”知识点。